隐含有“十九畏”的中成药药组是
A. 天麻丸与川贝枇杷露
B. 四神丸与更衣丸
C. 胆宁片与苏合香丸
D. 复方丹参滴丸与速效救心丸
E. 乌鸡白凤丸与平胃散

正确答案：C。胆宁片与苏合香丸

解析：本题考查的是中成药联用的配伍禁忌。隐含有“十九畏”的中成药药组是胆宁片与苏合香丸（C对）。含“十八反”“十九畏”药味中成药的配伍禁忌：现行版《中国药典》中有不宜同用药的规定，从不宜同用药的品种来看没有突破“十八反”和“十九畏”所含的品种。“十八反”“十九畏”中的药物，应属配伍禁忌，原则上是禁止联用。对于饮片处方，如果药味中含有“十八反”“十九畏”药物，那是比较容易发现的。但对于中成药，只有熟悉中成药制剂的处方内容，才有可能发现此类的配伍禁忌。例如，治疗风寒湿痹证的大活络丸、尪痹冲剂、天麻丸、人参再造丸等均含有附子，而止咳化痰的川贝枇杷露（A错）、蛇胆川贝液、通宣理肺丸等分别含有川贝、半夏，依据配伍禁忌原则，若将上述两组合用，附子、乌头与川贝、半夏当属相反禁忌同用之列。利胆中成药利胆排石片、胆乐胶囊、胆宁片等都含有郁金，若与六应丸、苏合香丸、妙济丸、纯阳正气丸、紫雪散等含丁香（母丁香）的中成药同时使用，就要注意具“十九畏”药物的禁忌。临床常用中成药心通口服液、内消瘰疬丸中含有海藻，祛痰止咳颗粒含有甘遂，若与橘红痰咳颗粒、通宣理肺丸、镇咳宁胶囊等含甘草的中成药联用也属禁忌之列。四神丸与更衣丸（B错）用米汤送服，取其保护肾气。复方丹参滴丸与速效救心丸（D错）同属气滞血瘀型用药，其处方组成与功效基本相似，而且这一类的药物多数含有冰片，由于冰片药性寒凉，服用剂量过大易伤人脾胃，导致胃痛胃寒，故不可过量使用，在临床应用中使用其中一种即可。乌鸡白凤丸与平胃散（E错），以乌鸡白凤丸为主药治疗妇女气血不足、月经失调，辅以香砂六君丸，以开气血生化之源，增强主药的养血调经之功；以二陈丸燥湿化痰为主方治疗湿痰咳嗽，而脾为生痰之源，辅以平胃散同用，燥湿健脾，可明显增强二陈丸燥湿化痰之功。